主要的感觉现象不包括
A. 感觉适应
B. 感觉方式
C. 感觉后像
D. 感觉融合
E. 感觉对比

正确答案：B。感觉方式

解析：主要的感觉现象有：感觉适应、感觉后像、感觉对比、感觉融合、感觉的相互作用。B项属于干扰项。掌握“认识过程”知识点。